对已确认发生严重不良反应的药品，可以采取停止生产、销售、使用的紧急控制措施的是
A. 地方人民政府和药品监督管理部门
B. 国务院或者省级人民政府的药品监督管理部门
C. 药品监督管理部门及其设置的药品检验机构
D. 药品监督管理部门及其设置的药品检验机构的工作人员
E. 药品生产、经营企业和医疗机构的药品检验机构或者人员

正确答案：B。国务院或者省级人民政府的药品监督管理部门

解析：本题考查药品监督管理。药品上市许可持有人、药品生产企业、药品经营企业和医疗机构应当经常考察本单位所生产、经营、使用的药品质量、疗效和不良反应。发现疑似不良反应的，应当及时向药品监督管理部门和卫生健康主管部门报告。对已确认发生严重不良反应的药品，由国务院药品监督管理部门或者省、自治区、直辖市人民政府药品监督管理部门（B对）根据实际情况采取停止生产、销售、使用等紧急控制措施，并应当在五日内组织鉴定，自鉴定结论作出之日起十五日内依法作出行政处理决定。药品存在质量问题或者其他安全隐患的，药品上市许可持有人应当立即停止销售，告知相关药品经营企业和医疗机构停止销售和使用，召回已销售的药品，及时公开召回信息，必要时应当立即停止生产，并将药品召回和处理情况向省、自治区、直辖市人民政府药品监督管理部门和卫生健康主管部门报告。药品生产企业、药品经营企业和医疗机构应当配合。药品上市许可持有人依法应当召回药品而未召回的，省、自治区、直辖市人民政府药品监督管理部门应当责令其召回。地方人民政府和药品监督管理部门（A错）不得以要求实施药品检验、审批等手段限制或者排斥非本地区药品生产企业依照本法规定的药品进入本地区。药品监督管理部门及其设置的药品检验机构（C错）不得参与药品生产经营活动，不得以其名义推荐或者监制、监销药品。药品监督管理部门及其设置的药品检验机构的工作人员（D错）不得参与药品生产经营活动。药品生产、经营企业和医疗机构的药品检验机构或者人员（E错）应当接受当地药品监督管理部门设置的药品检验机构的业务指导。